关于妊娠期的子宫，正确的是
A. 妊娠12周后可在耻骨联合上方触及
B. 子宫增大主要是因为肌细胞数目增多
C. 妊娠晚期子宫轻度左旋
D. 妊娠晚期子宫容量约500ml
E. 妊娠早期子宫呈对称的球形

正确答案：A。妊娠12周后可在耻骨联合上方触及

解析：妊娠12周后可在耻骨联合上方2-3指触及（A对）。子宫各部增长速度：宫底于妊娠后期增长最快，宫体含肌纤维最多，子宫下段次之，宫颈最少，故子宫各部不是对称球形（E错）。妊娠晚期子宫容量约5000ml（D错）。随妊娠进展，胎儿、胎盘及羊水的形成与发育，子宫体逐渐增大变软（B错）。妊娠晚期子宫轻度右旋，与乙状结肠占据在盆腔左侧有关（C错）。